滋补药头煎的煎煮时间，一般为煮沸后再煎
A. 10～15分钟
B. 20分钟
C. 40～60分钟
D. 45分钟
E. 1小时

正确答案：C。40～60分钟

解析：本题考查的是中药汤剂的煎煮程序。滋补药头煎的煎煮时间，一般为煮沸后再煎40～60分钟（C对）。煎药时间的长短，常与加水量、火力、药物吸水能力及治疗作用有关。中药煎煮一般分为一煎、二煎。一般药一煎沸后煎20～30分钟，二煎沸后煎15～20分钟；解表、清热、芳香类药不宜久煎，一煎沸后煎15～20分钟，二煎沸后煎10～15分钟；而滋补药一煎沸后文火煎40～60分钟，二煎沸后煎30～40分钟为宜。